女婴，早产儿，生后3天，出现反应低下，不吃、不哭、不动、体温不升、皮肤粘膜斑点皮肤呈大理石花纹。考虑最可能的是
A. 新生儿寒冷损伤综合症
B. 新生儿败血症
C. 新生儿溶血病
D. 新生儿缺氧缺血性脑病
E. 生理性黄疸

正确答案：B。新生儿败血症